《中华人民共和国药品管理法实施条例》规定，中药饮片必须印有或者贴有
A. 标签
B. 拉丁文名称
C. 中药饮片标识
D. 功能与主治
E. 禁忌

正确答案：A。标签

解析：本题考察药品管理。中药饮片必须印有或者贴有标签（A对）。